与鼻骨和泪骨相接，并参与泪沟的构成的是
A. 额突
B. 颧突
C. 腭突
D. 喙突
E. 上颌牙槽突

正确答案：A。额突

解析：额突与额骨、鼻骨和泪骨相接，并参与泪沟的构成。掌握“上颌骨解剖特点”知识点。